肩周炎是自限性疼病，一般恢复时间需要
A. 1个月左右
B. 3个月左右
C. 6-24个月左右
D. 3年左右
E. 3年左右

正确答案：C。6-24个月左右

解析：肩周炎是由多种原因导致的肩盂肱关节囊炎性粘连、僵硬，以肩关节周围疼痛、各方向活动受限为特点，又称粘连性肩关节炎、冻结肩、五十肩。该病具有自限性，一般恢复时间为6～24个月（C对）。